急性胰腺炎假性囊肿形成的时间一般是病后
A. 3～4小时
B. 24小时
C. 3～4天
D. 3～4周
E. 3～4月

正确答案：D。3～4周

解析：胰腺假性囊肿多在急性出血坏死性胰腺炎起病后3～4周（D对）（八版内科学已改为4周）形成，初期为含有胰酶和坏死组织的液体积聚，无明显囊壁，后期由肉芽组织或纤维组织构成囊壁，缺乏上皮，称为假性囊肿。胰腺脓肿一般在病后2～3周左右出现。